女性，23岁。寒战，高热，咳脓痰2天。查体：体温39.2℃，左肺闻及湿啰音。X线胸片示：左下肺大片状致密影，给予抗生素治疗，2天后症状加重，胸痛并呼吸困难，左胸呼吸音降低。胸片示左胸腔积液。目前考虑为
A. 重症肺炎
B. 肺炎合并肺脓肿
C. 肺炎合并急性脓胸
D. 肿瘤渗出性胸膜腔积液
E. 结核渗出性胸膜腔积液

正确答案：C。肺炎合并急性脓胸

解析：患者为青年女性，寒战、高热、咳浓痰2天，体温39.2℃，左肺闻及湿啰音，X线胸片示：左下肺大片状致密影，根据其临床表现和辅助检查，可考虑诊断为肺炎。患者胸痛并呼吸困难，左胸呼吸音降低，胸片示左胸腔积液（AB错）考虑为肺炎合并胸腔积液，如积液呈脓性则称脓胸（C对）。肿瘤渗出性胸膜腔积液（D错）好发于中老年，一般无寒战、高热、咳浓痰，胸片可看到肿瘤的阴影，无肺大片状致密影。结核渗出型胸膜腔积液（E错）常伴有干咳、潮热、盗汗、消瘦等结核中毒症状，无寒战、高热、咳浓痰的表现。